男，68岁。阵发性胸闷3年，持续加重6小时后突发意识丧失。查体：BP40/20mmHg，双肺呼吸音清，心率32次/分，律齐，各瓣膜区未闻及杂音。血清肌钙蛋白水平增高。该患者意识丧失的最可能原因是
A. 心肌病
B. 主动脉夹层
C. 急性肺栓塞
D. 主动脉瓣狭窄
E. 急性心肌梗死

正确答案：E。急性心肌梗死

解析：患者长期阵发性胸闷，持续加重6小时候意识丧失，血清肌钙蛋白水平升高，属于心肌梗死的典型标记物，因此本患者应诊断为急性心肌梗死（E对）。心肌病（P261）一般会出现心脏杂音，与患者未见杂音的体征不符，心肌病可出现血清肌钙蛋白的升高，但缺乏特异性，因此不作为首选诊断（A错）。主动脉夹层（P324）一开始即出现胸痛，两上肢血压和脉搏可有明显差别，可出现主动脉瓣关闭不全，患者未出现典型症状及体征，故不作为首选诊断（B错）。急性肺栓塞（P100）常出现呼吸困难，胸痛，咯血症状，肺部常出现哮鸣音和细湿啰音，与患者双肺呼吸音清的体征不符，因此不作为首选诊断（C错）。主动脉瓣狭窄一般可在主动脉瓣听诊区闻及粗糙响亮的射流样杂音，本患者未闻及杂音，故不作为首选诊断（D错）。